下列哪种检测结果表示乙肝感染已恢复
A. HBsAg（﹢），HBeAg（﹢）
B. HBsAg（﹢），抗-HBe（﹢），抗-HBc（﹢）
C. HBsAg（﹢），HBeAg（﹢），抗-HBc IgM（﹢）
D. HBsAg（﹢），抗-HBc（﹢）
E. 抗-HBc IgG（﹢），抗-HBs（﹢）

正确答案：E。抗-HBc IgG（﹢），抗-HBs（﹢）

解析：本题考查HBV血清学标志实验室检测结果的常见模式及意义。当机体的抗-HBs和抗-HBc IgG均呈阳性（E对ABCD错）时，标明乙肝既往感染，已恢复。